随着吸烟量的增加，肺癌的发生危险（RR）也增加，由此支持吸烟导致肺癌的因果联系，这一推理运用的是
A. 求同法
B. 差异法
C. 共变法
D. 同异并用法

正确答案：C。共变法

解析：本题考查病因及其发现和推断中的共变法。共变法认为，当某一现象存在一种变异或发生一种变化时，另一现象相应存在变异或随之发生变化，且不论后者的变异和变化是什么，那么二者间可能存在因果关系。随着吸烟量的增加，肺癌的发生危险也增加，由此支持吸烟导致肺癌的因果联系，这一推理运用的是共变法（C对ABD错）。